常常由于人与工作岗位的要求不相适应而造成
A. 环境性应激源
B. 心理性应激源
C. 社会性应激源
D. 职业性应激源
E. 生活性应激源

正确答案：D。职业性应激源

解析：职业性应激源指与工作有关的应激源，常常由于人与工作岗位的要求不相适应而造成。当然，不良的作业环境、人际关系障碍、组织的激励机制、组织结构也是重要的应激源。掌握“心理应激”知识点。